最早提出“治未病”的书籍是
A. 《黄帝内经》
B. 《难经》
C. 《伤寒杂病论》
D. 《千金方》
E. 《神农本草经》

正确答案：A。《黄帝内经》

解析：最早提出“治未病”的书籍是《内经》（A对）。《难经》、《金匱要略》对“治未病”的思想有阐发，但不是最早提出（BC错）；《千金方》对《皇帝内经》“治未病”的理论进行深化（D错）；《神农本草经》蕴含着治未病思想（E错）。